以下哪项不是流行病学研究的范围
A. 疾病的流行特征
B. 疾病的病因
C. 疾病的防制措施
D. 流行病学研究方法
E. 疾病的临床诊治

正确答案：E。疾病的临床诊治